依据《食品经营许可管理办法》，食品经营许可实行的原则是
A. 多地一证
B. 一地一证
C. 多企一证
D. 一企多证
E. 一企一证

正确答案：B。一地一证

解析：本题考查依据《食品经营许可管理办法》，食品经营许可实行的原则。依据《食品经营许可管理办法》，食品经营许可实行的原则是一地一证原则（B对ACDE错），即食品经营者在一个经营场所从事食品经营活动，应当取得一个食品经营许可证。